身热，面目俱赤，便秘，腹胀，口干咽燥，呼吸气粗，苔黄，脉沉涩属于
A. 上焦病证
B. 中焦病证
C. 下焦病证
D. 卫分病证
E. 营分病证

正确答案：B。中焦病证

解析：温热之邪内入阳明，燥热炽盛，故见身热；邪热壅盛，故呼吸气粗；热性炎上，故见面目俱赤；热赤津伤，故渴口干咽燥；胃肠津亏，燥屎内停，故见腹胀便秘；故可辨证为中焦阳明燥热证（B对）。上焦病证表现为发热，微恶风寒，微汗出，头痛，咳嗽，鼻塞，口渴，舌边尖红，脉浮数（A错）。下焦病证表现为身热，手足心热甚于手足背，颧红，口舌干燥，神倦，耳聋，舌红少苔，脉虚大（C错）。卫分病证常见于外感温热病初起，主要表现为发热，微恶风寒，头痛，口干微渴等（D错）。营分证是温热病发展过程中较为深重的阶段，主要表现为身热夜甚，心烦不寐，神昏谵语，斑疹隐隐等（E错）。